用于治疗疥疮、皮肤瘙痒的药物是
A. 炉甘石洗剂
B. 莫匹罗星软膏
C. 克罗米通乳膏
D. 联苯苄唑乳膏
E. 过氧苯甲酰凝胶

正确答案：C。克罗米通乳膏

解析：本题考查克罗米通乳膏。用于治疗疥疮、皮肤瘙痒的药物是克罗米通乳膏（C对）。炉甘石洗剂（A错）用于急性瘙痒性皮肤病，如湿疹和痱子。莫匹罗星软膏（B错）可用于革兰氏阳性球菌引起的皮肤软组织的感染，如脓疱疮、疖、毛囊炎等原发性感染以及湿疹、皮炎、溃疡、外伤等皮肤病。联苯苄唑乳膏（D错）用于治疗各种皮肤真菌病，如足癣、体癣、股癣。过氧苯甲酰凝胶（E错）为强氧化剂，可杀灭痤疮丙酸杆菌，并有使皮肤干燥和脱屑作用，用于寻常痤疮。